参与围成椎间孔
A. 椎体与椎弓
B. 椎弓根与椎弓板
C. 椎体与椎弓根
D. 相邻椎弓根
E. 椎体与椎弓板

正确答案：D。相邻椎弓根

解析：椎弓根的上、下缘分别称椎上、下切迹 ，相邻椎骨的上、下切迹共同围成椎间孔（D对）。椎体与椎弓围成椎孔（A错）。